恶性贫血和巨幼红细胞性贫血选用
A. 硫酸亚铁
B. 叶酸
C. 维生素B₁₂
D. 重组人促红素
E. 腺嘌呤

正确答案：C。维生素B₁₂

解析：本题考查维生素B₁₂。维生素B₁₂（C对）适用于巨幼红细胞贫血、神经炎、恶性贫血等。硫酸亚铁（A错）用于防治各种原因引起的缺铁性贫血。叶酸（B错）可用于叶酸缺乏所致的巨幼红细胞贫血。重组人促红素（D错）可外源性补充。腺嘌呤（E错）用于防治各种原因引起的白细胞减少症，急性中性粒细胞减少症。